重叠奔马律常见于
A. 病态窦房结综合征
B. 房性期前收缩
C. 心力衰竭伴心动过速
D. 肥厚型心肌病
E. 三度房室传导阻滞

正确答案：C。心力衰竭伴心动过速

解析：重叠奔马律为舒张早期和晚期奔马律在快速性心律或房室传导时间延长时在舒张中期重叠出现引起，当心率较慢时，两种奔马律可没有重叠，听诊时为4个心音，称舒张期四音律，常见于心肌病或心力衰竭。心力衰竭伴心动过速（C对）可见重叠奔马律。奔马律提示严重心肌损害。病态窦房结综合征（八版内科学P184）（A错）病变出现在窦房结；房性期前收缩（B错）是指激动起源于窦房结以外心房的任何部位，主要表现冲动起源的异常，两种疾病均没有心肌的损害，不会出现奔马律。肥厚型心肌病（D错）的特征为心室壁呈不对称性肥厚，左心室舒张期顺应性下降，出现舒张晚期奔马律。完全性房室传导阻滞（三度房室传导阻滞）（E错），是指由于房室传导系统某部分的传导能力异常降低，所有来自心房的激动都不能下传至心室而引起完全性房室分离，一般不会产生奔马律。